下列各项，不属痛经常见证型的是
A. 气滞血瘀
B. 湿热瘀阻
C. 肝肾亏虚
D. 寒湿凝滞
E. 肝脾不和

正确答案：E。肝脾不和

解析：素性抑郁，或忿怒伤肝，肝郁气滞，血行瘀阻，冲任胞脉受阻，血行不畅，经前经期气血下注冲任，胞脉气血更加壅滞，不通则痛，则发为痛经气滞血瘀证（A对）。素有湿热内蕴，或经期产后摄生不慎，感受湿热之邪，与血搏结，稽留任脉，蕴结胞中，气血不畅，经前经期气血下注冲任，胞脉壅滞更甚，不通则痛，则发为痛经湿热瘀阻证（B对）。肝肾亏损证-素禀肾虚，或房劳多产伤肾，或久病耗伤精血，导致肝肾不足，精血亏少，经后精血更亏，胞脉失于濡养，不荣则痛，则发为痛经肝肾亏损证（C对）。经期冒雨涉水，或感寒饮冷，寒客冲任胞宫，血为寒凝，经前经期气血下注冲任，胞脉气血更加瘀滞，不通则痛，则发为痛经寒湿凝滞证（D对）（E错，为本题正确答案）。